椿皮的功效是
A. 涩肠
B. 杀虫
C. 止带
D. 止血
E. 清热燥湿

正确答案：A、B、C、D、E。涩肠；杀虫；止带；止血；清热燥湿

解析：本题考查的是椿皮的功效。椿皮的功效是涩肠（A对）、杀虫（B对）、止带（C对）、止血（D对）与清热燥湿（E对）。椿皮：【功效】清热燥湿，涩肠，止血，止带，杀虫。